下列不属于降压治疗原则改善生活行为的是
A. 增加运动
B. 戒烟、限制饮酒
C. 补充钙和钾盐
D. 增加钠盐摄入
E. 减轻体重

正确答案：D。增加钠盐摄入

解析：高血压治疗性的生活方式干预适用于所有高血压患者。减轻体重、减少钠盐摄入、补充钾盐、减少脂肪摄入、戒烟限酒、增加运动、减轻精神压力，保持心态平衡、必要时补充叶酸制剂等行为均是有助于降压治疗的生活方式。掌握“原发性高血压”知识点。